男，32岁。因肝损伤急诊手术。曾患甲型肝炎已治愈。术中见肝右叶外侧5cm裂口，深3cm。术后肝肾功能检查正常，食欲、体力恢复正常。肝脏损伤得以顺利修复，从内环境分析，主要起再生作用的是
A. 不稳定细胞
B. 肥大细胞
C. 纤维细胞
D. 稳定细胞
E. 永久性细胞

正确答案：D。稳定细胞

解析：肝脏的再生能力是由其复制潜能决定的，当肝脏受到损伤时，稳定细胞（D对）将进入DNA合成前期，表现出较强的再生能力。不稳定细胞（A错）又称持续分裂细胞，这类细胞总在不断地增殖，以代替衰亡或破坏的细胞，如表皮细胞、呼吸道和消化道黏膜被覆细胞等。肥大细胞（B错）又称组织嗜碱性细胞，广泛分布于全身各疏松结缔组织内，可分泌多种细胞因子，参与免疫调节。纤维细胞（C错）是结缔组织中数目最多的细胞，相对静止的称纤维细胞，功能较活跃的称成纤维细胞（纤维母细胞），成纤维细胞在创伤修复中起重要的作用。永久性细胞（E错）又称非分裂细胞，包括神经细胞、骨骼肌细胞和心肌细胞，这类细胞不能分裂增生，一旦遭到破坏将永久性缺失。